患者，男，67岁，既往有癫痫病史。因感染性脑膜炎入院治疗，在脑脊液标本的病原学结果回报之前可经验性选用的抗菌药物是
A. 米诺环素
B. 亚胺培南西司他丁
C. 头孢曲松
D. 卡泊芬净
E. 阿米卡星

正确答案：C。头孢曲松

解析：本题考查抗菌药物头孢曲松。根据题干，该患者可选用的抗菌药物是头孢曲松（C对）。头孢曲松临床可用于敏感致病菌所致的脑膜炎。米诺环素（A错）用于敏感菌引起的各类疾病，如败血症、梅毒、尿道炎、支气管炎等。亚胺培南西司他丁（B错）可以治疗脑膜炎，但是可引起中枢神经系统严重不良反应，该患者既往有癫痫病史，不宜使用。卡泊芬净（D错）用于其它药物治疗无效或不能耐受的侵袭性曲霉菌病，用于食管念珠菌病、念珠菌血症，念珠菌所致腹腔内脓肿、腹膜炎、胸膜腔感染，经验性治疗中性粒细胞减少伴发热患者的可疑真菌感染。阿米卡星（E错）用于敏感菌所致的严重感染。